食品在一定环境因素下，微生物作用使食品成分与感官性质发生变化，通称为
A. 食品酸败
B. 食品变性
C. 食品腐败变质
D. 食品腐烂
E. 食品恶变

正确答案：C。食品腐败变质

解析：本题考查食品腐败变质。食品腐败变质（C对ABDE错）是指食品在以微生物为主的各种因素作用下，其原有化学性质或物理性质发生变化，降低或失去其营养价值的过程。